牙髓切断术后潜在的并发症包括
A. 根管钙化
B. 根管钙化、根折
C. 根管钙化、根折、内吸收
D. 根管钙化、内吸收及牙髓坏死
E. 根管钙化、根折、内吸收、牙髓坏死

正确答案：D。根管钙化、内吸收及牙髓坏死

解析：本题考查牙髓切断术后潜在的并发症。牙髓切断术后，牙髓断面发生急性炎症反应或表层坏死。随着时间推移可出现进行性牙髓钙化，或断面处有部分牙本质桥，根髓已发展为慢性炎症，发展为牙髓坏死或发生内吸收，因此根管钙化、内吸收及牙髓坏死（D对）是牙髓切断术的潜在的并发症，应要求患者在术后2-4年内定期复查。根折一般发生在外伤或无正常牙髓提供营养的患牙，如做过根管治疗的牙。牙髓切断术后根部仍为生活牙髓，继续营养牙齿，一般不会发生根折（BCE错）。